患儿，男性，2岁，右侧完全性腭裂拟行腭裂修复术,术后如需配合系统性语音训练，最好在
A. 术后1个月进行
B. 术后3个月进行
C. 术后6个月进行
D. 4～6岁时进行
E. 12岁以后进行

正确答案：A。术后1个月进行

解析：本题考查腭裂语音治疗。患儿，男性，2岁，右侧完全性腭裂拟行腭裂修复术,术后如需配合系统性语音训练，最好在术后1个月进行（A对）。腭裂语音治疗的适应证：1.良好的腭咽闭合功能者，否则，语音治疗一般是难以有效果的。2.即使咽成形术获得成功，但因患者不良发音习惯已经养成，各种代偿发音造成异常语音者均应该通过语音治疗给予纠正，因此，术前与患者和家属有良好的沟通不应被忽视。3.4周岁以上患儿能与语音治疗师配合的可行语音治疗，不合作者，可嘱家属先在家进行一些行为疗法，如吹水泡，鼓气，吹口琴等训练。4.排除听力障碍（听觉不能低于50dB），舌系带过短等影响训练的因素。5.患儿智商基本正常（智商IQ不应低于70分），严重弱智或难以配合治疗者，疗效差。6.符合以上条件者，手术后1个月可开始语音训练。